恶性高血压的肾脏特征性病变时
A. 肾小球纤维化
B. 肾细小动脉纤维素样坏死
C. 肾小叶间动脉内膜增厚
D. 肾小球毛细血管内血栓形成
E. 肾小管上皮变性

正确答案：B。肾细小动脉纤维素样坏死

解析：恶性高血压的肾脏特征性病变是增生性小动脉硬化和坏死性细动脉炎，前者的主要表现为肾小球动脉内膜显著增厚，肾小叶间动脉内膜增厚（C错）可出现，但不是特征性病变；后者的主要表现为肾细小动脉纤维素样坏死（B对）。肾小球纤维化（A错）为各种肾小球损伤发展到终末阶段的病理变化（P273）。肾小球毛细血管内血栓形成（D错）可见于DIC（弥散性血管内凝血），常为透明血栓。肾小管上皮变性（E错）可见于部分肾小管-间质性肾炎。